胎产式是指
A. 最先进入骨盆上口的胎儿部分
B. 胎儿先露部的指示点与母体骨盆的关系
C. 胎儿身体长轴与母体长轴的关系
D. 胎儿在子宫内的姿势
E. 以上都不对

正确答案：C。胎儿身体长轴与母体长轴的关系

解析：胎儿肢体长（纵）轴与母体长（纵）轴的关系称为胎产式（C对E错）。最先进入骨盆入口的胎儿部分叫做胎先露（A错）。胎儿先露部位是指胎儿的最低点，胎儿先露部位的指示点与母体骨盆之间的关系，又称为胎方位（B错）。胎儿在子宫内的姿势是叫胎位（D错）。